需长期使用糖皮质激素的慢性疾病最适宜的给药方案是
A. 早晨1次
B. 晚饭前1次
C. 每日3次
D. 午饭后1次
E. 睡前1次

正确答案：A。早晨1次

解析：本题考查糖皮质激素的使用。需长期使用糖皮质激素的慢性疾病最适宜的给药方案是早晨1次（A对）。糖皮质激素类的时辰应用：（1）应用糖皮质激素治疗疾病时，08：00时1次予以全天剂量比1天多次给药效果好，不良反应少；（2）皮质激素治疗肾上腺性征异常症，早晨不给药而中午给以小剂量，下午给予1次大剂量，夜间给予最大剂量。